微波炉用塑料饭盒等用品接触沸水或某些溶剂时，可能会有什么环境内分泌干扰物质产生
A. PCB
B. TCDD
C. 壬酚
D. 二噁英
E. 双酚A

正确答案：E。双酚A

解析：本题考查微波炉用塑料饭盒等用品接触沸水或某些溶剂时，可能会产生的环境内分泌干扰物质。微波炉用塑料饭盒等用品接触沸水或某些溶剂时，可能会有双酚A（E对ABCD错）等环境内分泌干扰物质产生。